植物油的制取方法不包括
A. 压榨法
B. 浸出法
C. 超临界流体萃取法
D. 熬炼法
E. 水溶剂法

正确答案：D。熬炼法

解析：本题考查植物油的制取方法。制取植物油可采用压榨法（A对）、浸出法（B对）、超临界流体萃取法（C对）、水溶剂法（E对）和酶解法等。熬炼法（D错，为本题正确答案）是动物油脂的制取方法。